患者查阅医疗记录和复印部分病历的权利属于
A. 平等就医权
B. 特殊干涉权
C. 隐私保护权
D. 损害赔偿权
E. 知情同意权

正确答案：E。知情同意权

解析：患者查阅医疗记录和复印部分病历的权利属于知情同意权（E对）。